直肠长度约为
A. 5～10cm
B. 12～15cm
C. 16～20m
D. 21～25cm
E. 26～30cm

正确答案：B。12～15cm

解析：直肠位于盆腔后部，上接乙状结肠，下连肛管，全长12～15cm（B对）。